关于尺动脉的描述，不正确的是
A. 约在桡骨颈平面发自肱动脉
B. 发出骨间总动脉
C. 发出拇主要动脉
D. 参与构成掌深弓
E. 参与构成掌浅弓

正确答案：C。发出拇主要动脉

解析：尺动脉约在桡骨颈平面发自肱动脉（A对）。发出骨间总动脉（B对C错，为本题正确答案）和掌深支参与构成掌深弓（D对）。尺动脉末端与桡动脉的掌浅支吻合形成掌浅弓（E对）。